治疗快速心律失常心神不宁证，应首选的方剂是
A. 天王补心丹
B. 酸枣仁汤
C. 归脾汤
D. 桂枝甘草龙骨牡蛎汤
E. 安神定志丸

正确答案：E。安神定志丸

解析：快速心律失常心神不宁证的病机为心主藏神，心神不能自主，故见心悸心慌，善惊易恐，坐卧不安，失眠多梦，故其治法是镇惊定志、养心安神，首选方药为养心安神定志的安神定志丸加减（E对）。天王补心丹（A错）可滋阴清火，养心安神，用于治疗阴虚火旺证；酸枣仁汤（B错）可清热除烦，养血安神，用于治疗肝血不足，虚热扰神证；归脾汤（C错）可补血养心，益气安神，用于治疗气血不足证；桂枝甘草龙骨牡蛎汤（D错）合参附汤可温补心阳，安神定悸，用于治疗心阳不振证。